女，26岁。产后面色变红、肥胖1年半，乏力、头痛加重半年，并口渴多饮，夜间尿量达1700ml比白天多。查体：血压180/126mmHg、脉率104次/分，向心性肥胖，面色红黑有痤疮，皮肤薄乳晕及指关节伸侧色较深，腹壁胭窝及腋窝周围有紫纹，双下肢有可凹性水肿。对诊断最有提示意义的是血中
A. 血脂↑
B. 血糖↑
C. 醛固酮↑
D. 皮质醇↑
E. 儿茶酚胺↑

正确答案：D。皮质醇↑

解析：青年女性患者，产后出现向心性肥胖，面色红黑有痤疮、皮肤薄、乳晕及指关节伸侧色较深、腹壁胭窝及腋窝周围紫纹等皮肤表现，乏力头痛等肌肉神经系统表现，高血压、口渴多饮、夜尿增多、双下肢可凹性水肿等心血管系统表现及代谢障碍，符合库欣综合征的典型表现（P699），考虑诊断为库欣综合征。引起库欣综合征一系列临床表现的原因为血皮质醇水平升高，作用于全身各系统器官产生临床症状，因此血皮质醇升高（D对）对于库欣综合征的诊断最有价值。血脂升高（A错）主要见于高脂血症，临床上多种疾病均可出现高脂血症（P757）；血糖升高（B错）主要见于糖尿病，库欣综合征亦可出现血糖升高，二者均无特异性。醛固酮升高（C错）主要见于原发性醛固酮增多症（P703）。儿茶酚胺升高（E错）主要见于肾上腺嗜铬细胞瘤（P711）。